水体富营养化后期，溶解氧下降，有机物厌氧分解，其产物主要是
A. 二氧化碳、水、硝酸盐
B. 藻类毒素
C. 硫化氢、甲烷
D. 甲烷、水、硝酸盐
E. 硫化氢、硝酸盐

正确答案：C。硫化氢、甲烷

解析：本题考查有机物厌氧分解的产物。水体富营养化后期，溶解氧下降，有机物厌氧分解，其产物主要是甲烷、硫化氢（C对ABDE错）、氨、氢和二氧化碳等。